患者，女，31岁，阴道分泌物增多3天，妇科查体：阴道黏膜充血，阴道分泌物呈稀薄脓性泡沫状，阴道分泌物检查最可能的结果是
A. 涂片可见芽孢和菌丝
B. 核酸扩增实验衣原体阳性
C. 涂片见中性粒细胞内含革兰阴性双球菌
D. 悬滴法发现阴道毛滴虫
E. 暗视野显微镜发现螺旋体

正确答案：D。悬滴法发现阴道毛滴虫

解析：该患者女，31岁，阴道分泌物增多3天，妇科查体：阴道黏膜充血，阴道分泌物呈稀薄脓性泡沫状（滴虫性阴道炎的表现），阴道分泌物检查最可能的结果是悬滴法发现阴道毛滴虫（D对）。（P242）“外阴阴道假丝酵母菌病 对有阴道炎症症状或体征的妇女，若在阴道分泌物中找到假丝酵母菌的芽生孢子或假菌丝即可确诊”（A错）。（P116）“淋病 根据病史、临床表现和实验室检查做出诊断，实验室检查包括：①分泌物涂片检查见中性粒细胞内有革兰阴性双球菌；②淋菌培养是诊断淋病的“金标准”；③核酸扩增试验”（C错）。（P117）“病原体检查：取病损处分泌物涂片，用暗视野显微镜或直接荧光抗体检查梅毒螺旋体确诊”（E错）。